患者，女，50岁。15年前因甲亢行甲状腺次全切除术。近1个月来又感心悸，出汗、消痩，心电图检查提示房颤，心率120次/分，FT₃升高，T₄升高。应首先考虑的治疗措施是
A. 第二次手术
B. 放射性治疗
C. 服抗甲状腺药与甲状腺素片
D. 服碘溶液
E. 甲状腺素片

正确答案：B。放射性治疗

解析：甲状腺功能亢进症最好的治疗是放射性治疗（B对），可以有效地破坏甲状腺组织细胞。此法安全简便，费用低廉，效益高，现已是治疗成人甲亢的首选疗法，适应于年龄在25岁以上，甲状腺肿及病情为中等程度的病人。使用抗甲状腺药物治疗效果差或治疗后复发的患者。对抗甲状腺药物过敏者。因为各种原因，不能长期坚持服药者。甲亢手术治疗后复发者。合并心脏病、糖尿病及严重肝、肾功能不全等有手术禁忌证者。甲亢伴有浸润性眼突者（ACDE错）。